在医院健康教育中，不属于住院教育形式的是
A. 入院教育
B. 病房教育
C. 出院教育
D. 随访教育
E. 出院后教育

正确答案：D。随访教育